一婴儿出现发热，咳嗽，咳痰气喘，胸透见双肺下叶散在分布着边界不清的阴影。最可能患的是
A. 大叶性肺炎
B. 干酪样肺炎
C. 间质性肺炎
D. 小叶性肺炎
E. 肺脓肿

正确答案：D。小叶性肺炎

解析：婴儿（小叶性肺炎的好发人群）发热、咳嗽、咳痰气喘，胸透见双肺下叶散在分布的边界不清的阴影（小叶性肺炎的典型影像学表现），根据患儿的症状及影像学表现，最可能的诊断是小叶性肺炎（D对）。大叶性肺炎（A错）病原体先在肺泡引起炎症，经肺泡间孔向其他肺泡扩散，致使部分肺段或整个肺段、肺叶发生炎症。X线影像显示肺叶或肺段的实变阴影。间质性肺炎（C错）呼吸道症状较轻X线影像表现为一侧或双侧肺下部不规则阴影，可呈磨玻璃状、网格状，其间可有小片肺不张阴影。干酪性肺炎（B错）大叶性干酪性肺炎X线影像呈大叶性密度均匀磨玻璃状阴影，逐渐出现溶解区，呈虫蚀样空洞，可出现播散病灶，痰中能查出结核分枝杆菌。肺脓肿（E错）是由多种病原体所引起的肺组织化脓性病变，早期为化脓性肺炎，继而坏死、液化、脓肿形成。临床特征为高热、咳嗽和咳大量脓臭痰，胸部X线或CT显示肺实质内厚壁空洞。